成熟红细胞中能量的主要来源是
A. 脂肪酸氧化
B. 糖有氧氧化
C. 氨基酸分解代谢
D. 糖酵解
E. 糖异生作用

正确答案：D。糖酵解

解析：本题考查成熟红细胞中能量的主要来源。成熟红细胞中能量的主要来源是糖酵解（D对）。脂肪酸氧化（A错）生成乙酰CoA，释放大量能量，需要在内质网和线粒体内进行。糖有氧氧化（B错）使机体产能的主要途径，需要在胞液和线粒体进行。氨基酸分解代谢（C错）主要在肝内进行，转化生成其他含氮物质。糖异生作用（E错）是机体长期饥饿、糖原耗尽后，依赖肝将氨基酸、乳酸等转变成葡萄糖，需要在胞液和线粒体内进行，其主要生理意义是维持血糖恒定。